属于第一代抗精神病药物的是
A. 氯氮平
B. 利培酮
C. 奥氮平
D. 氯丙嗪
E. 喹硫平

正确答案：D。氯丙嗪

解析：本题考查抗精神病药物。属于第一代抗精神病药物的是氯丙嗪（D对）；氯氮平（A错）、奥氮平（C错）、利培酮（B错）、喹硫平（E错）均为第二代抗精神病药物。